跨省、自治区、直辖市变更执业注册时新的执业地点注册应
A. 发给新的《医师执业证书》无需收回原《医师执业证书》
B. 原《医师执业证书》不予承认，重新参加考试
C. 使用原《医师执业证书》注册
D. 发给新的《医师执业证书》同时收回原《医师执业证书》
E. 在现工作地址进行申请

正确答案：D。发给新的《医师执业证书》同时收回原《医师执业证书》

解析：跨省、自治区、直辖市变更执业注册事项的，除依照上述规定办理有关手续外，新的执业地点注册主管部门在办理执业注册手续时，应收回原《医师执业证书》，并发给新的《医师执业证书》。掌握“执医概述及考试和注册”知识点。